女，38岁。接触性出血1个月余，白带有恶臭。妇科检查：宫颈Ⅱ度糜烂，前唇有5cm×3cm的质地脆赘生物、易出血。子宫正常大，三合诊（-）。确诊后，其临床期别为
A. ⅠA期
B. ⅠB₁期
C. ⅠB₂期
D. ⅡA期
E. ⅡB期

正确答案：C。ⅠB₂期

解析：该患者有接触性出血1个月余（子宫颈癌患者常表现为接触性阴道流血），白带有恶臭（子宫颈癌患者晚期因癌组织坏死伴感染，可有脓性恶臭白带）、宫颈Ⅱ度糜烂（子宫颈癌患者子宫颈表现为光滑或糜烂样改变）、前唇有5cm×3cm的质地脆赘生物、易出血（外生型子宫颈癌可见息肉状或菜花状赘生物，质脆易出血），子宫正常大小，结合患者的临床表现，可诊断为子宫颈癌。由于临床病灶为5cm（＞4cm），子宫正常大小，说明子宫未被侵犯，符合ⅠB₂期的诊断标准（C对）。ⅠA期（A错）指间质浸润深度＜5mm，宽度≤7mm。ⅠB₁期（B错）指临床癌灶≤4cm。ⅡA期（D错）指肿瘤侵犯阴道上2/3，无明显宫旁浸润。ⅡB期（E错）指有明显宫旁浸润，但未达到盆壁。